患者，女，66岁。近日发现口腔溃烂，影响进食，检查见下唇、两颊黏膜充血，局部形成糜烂，糜烂面上覆有一层灰白色假膜，假膜较厚微突出黏膜表面，致密光滑。擦去假膜，可见溢血的糜烂面。患者进食疼痛。淋巴结肿大压痛，白细胞增高，患者体温增高，且有特殊炎性口臭。该患者可能患有的疾病是
A. 天疱疮
B. 口腔念珠菌病
C. 球菌性口炎
D. 急性疱疹性龈口炎
E. 带状疱疹

正确答案：C。球菌性口炎

解析：本病可发生于口腔黏膜任何部位，口腔黏膜充血，局部形成糜烂或溃疡。在溃疡或糜烂的表面覆盖着一层灰白色或黄褐色假膜，假膜特点是较厚微突出黏膜表面，致密而光滑。擦去假膜，可见溢血的糜烂面。周围黏膜充血水肿。患者唾液增多，疼痛明显，有炎性口臭。区域淋巴结肿大压痛。有些患者可伴有发热等全身症状。涂片及细菌培养可明确诊断。血象检查白细胞数增高。掌握“球菌性口炎”知识点。